男，45岁。上腹痛伴烧心4年。多在餐后约1小时出现剑突下疼痛，1～2小时后可缓解。内科规范治疗1年，症状反复发作，曾有2次黑便。胃镜及X线钡剂造影均在胃角处见直径1.6cm大小溃疡，决定手术治疗。首选的术式为
A. 胃大部切除毕I式吻合术
B. 择性迷走神经切断术加引流术
C. Roux-en-Y吻合术加迷走神经干切断术
D. 胃大部切除毕II式吻合术
E. 高择性迷走神经切断术加引流术

正确答案：A。胃大部切除毕I式吻合术

解析：男，45岁。上腹痛伴烧心4年。多在餐后约1小时出现剑突下疼痛，1～2小时后可缓解。内科规范治疗1年，症状反复发作，曾有2次黑便。胃镜及X线钡剂造影均在胃角处见直径1.6cm大小溃疡，决定手术治疗。该患者诊断为胃溃疡，首选的术式为胃大部切除毕I式吻合术（A对），毕Ⅰ式是胃切除后，残胃与十二指肠直接吻合，仅一个吻合口，手术简单。胃肠道接近于正常解剖生理，术后因胃肠功能紊乱而引起的并发症少。